以下哪项临床症状血虚证与血瘀证均可见
A. 心悸
B. 脉涩
C. 手麻
D. 腹痛
E. 闭经

正确答案：E。闭经

解析：血虚证的证候表现为面色淡白或萎黄，眼睑、口唇、爪甲色淡，头晕眼花、心悸，失眠多梦，健忘，手足麻木，妇女经血量少色淡、延期甚或闭经，舌淡苔白，脉细无力。血瘀证，瘀阻胞宫则妇女经血有块，经行延期甚或闭经，淤血阻滞脉道，血运不畅，则脉涩、气血运行受阻，不通则痛故腹痛（E对）。